日本痛痛病的病因主要是
A. 当地土壤原生环境中含有大量镉
B. 气型镉污染土壤和水所致
C. 含镉废水污染农田而引起
D. 含镉废水污染了当地居民的水源水
E. 含镉废渣污染了土壤

正确答案：C。含镉废水污染农田而引起

解析：本题考查日本痛痛病的病因。痛痛病是发生在日本富山县神通川流域部分镉污染地区的一种严重的环境污染性疾病，以全身剧烈疼痛为主要症状而得名，是慢性镉中毒的典型案例。其病因主要是含镉废水污染农田而引起（C对ABDE错）。